直接吞服可能导致患者窒息的剂型是
A. 分散片
B. 滴丸剂
C. 肠溶片
D. 舌下片
E. 泡腾片

正确答案：E。泡腾片

解析：本题考查各种剂型的正确使用。泡腾片（E对）放入水中之后，产生大量二氧化碳，严禁直接吞服，可能会导致患者窒息。滴丸剂（B错）宜以少量温开水送服，有些可直接含于舌下。舌下片（D错）含服时把药片放在舌下，不要咀嚼或吞咽药物，含服后30分钟内不宜吃东西或饮水。分散片（A错）、肠溶片（C错）在最新版考试指导中未明确说明。